P地区和Q地区的年龄修正死亡率相等，但P地的粗死亡率比Q地区低，可以判断
A. 两个地区有相同的年龄分布
B. P地区的诊断比Q地区准确
C. P地区的老年人数占人口百分比比Q地区多
D. P地区的诊断比Q地区的准确性差
E. P地区的年轻人数所占人口的百分比比Q地区高

正确答案：E。P地区的年轻人数所占人口的百分比比Q地区高

解析：本题考查率的标准化的应用。两个地区有相等的年龄调整死亡率，说明死亡危险是相同的。之所以粗死亡率不同，是年龄构成不同所造成的。在年龄调整死亡率相同的情况下，粗死亡率越低，说明当地年龄构成越年轻。因此P社区较Q社区有更多的年轻人（E对ABCD错）。